腹痛、腹泻黏液脓血便，伴发热恶寒，最可能的诊断是
A. 细菌性痢疾
B. 阿米巴痢疾
C. 急性胃肠炎
D. 流行性脑脊髓炎
E. 霍乱

正确答案：A。细菌性痢疾

解析：腹痛、腹泻黏液脓血便，伴发热恶寒，最可能的诊断是细菌性痢疾（A对）。阿米巴痢疾（B错）表现为果酱样便。急性胃肠炎（C错）表现为黏液样变性而无脓血。流行性脑脊髓炎（D错）主要表现为突发高热、剧烈头痛、频繁呕吐、皮肤黏膜瘀点、瘀斑及脑膜刺激征，无腹痛、腹泻黏液脓血便的表现。霍乱（E错）表现为米泔水样便，多无腹痛。